首创药物自然属性分类法的本草著作是
A. 《神农本草经》
B. 《本草纲目拾遗》
C. 《本草经集注》
D. 《新修本草》
E. 《证类本草》

正确答案：C。《本草经集注》

解析：本题考查的是《本草经集注》。首创药物自然属性分类法的本草著作是《本草经集注》（C对）。《本草经集注》：为魏晋南北朝本草代表作。作者为陶弘景，书成于公元500年左右（南北朝梁代）。在序例部分除对《本经》条文逐一注释、发挥外，又补充了大量采收、鉴别、炮制、制剂、合药取量、诸病通用药及服药食忌等内容，大大丰富了药学理论。在各论首创按药物自然属性分类法，将所载730种药物分为玉石、草木、虫兽、果、菜、米食及有名未用7类。该书第一次全面系统地整理、补充了《本经》，反映了魏晋南北朝时期的本草学成就，初步确立了综合性本草著作的编写模式。《神农本草经》（A错）：简称《本经》，为汉代本草代表作。其序例部分简要地总结了药物的四气五味、有毒无毒、配伍法度、服药方法、剂型选择等基本原则，初步奠定了中药学的理论基础。各论载药365种，以上、中、下三品分类，所记功用大多朴实有验。该书系统总结了汉代以前我国药学发展的成就，是现存最早的药学专著，为本草学的发展奠定了基础。《本草纲目拾遗》（B错）：简称《纲目拾遗》，为清代本草代表作。作者赵学敏，定稿于1803年（清嘉庆八年）。全书共10卷，载药921种，其中新增716种，创古本草增收新药之冠，极大地丰富了本草学。同时，对《本草纲目》略而不详的加以补充，错误的加以订正，不但总结了16～18世纪本草学发展的新成就，而且还保存了大量今已散佚的方药书籍的部分内容，具有很高的实用价值和文献价值。《新修本草》（D错）：又称《唐本草》，为隋唐时期唐代的本草代表作。书成于公元659年（唐显庆四年），共54卷，载药850种。书中增加了药物图谱，并附以文字说明，开创了图文对照法编撰药学专著的先例。本书是我国历史上第一部官修药典性本草，并被今人誉为世界上第一部药典。该书无论在内容和编写形式上都有新的突破，全面总结了唐以前的药物学成就，并很快流传下海内外，对后世医药学的发展影响极大。《证类本草》（E错）：即《经史证类备急本草》，为宋金元时期宋代的本草代表作。作者唐慎微，以掌禹锡的《嘉祐本草》和苏颂的《图经本草》为基础，并收集转录了大量宋以前各代名医对本草的真知灼见、经史传记和佛书道藏中有关本草的论述，以及民间防治疾病的经验和单方，撰成此书。书稿定稿于1108年（宋大观二年）以前。全书共30卷，载药1746种，附方3000余首。该书图文对照，方药并收，医药结合，资料翔实，集宋以前本草之大成，使大量古代文献得以保存，具有极高的学术价值和文献价值。